形状为圆形厚片，切面黄白色，粉性，有多数细孔的饮片是
A. 莪术
B. 丹参
C. 泽泻
D. 桔梗
E. 板蓝根

正确答案：C。泽泻

解析：本题考查的是泽泻饮片的性状鉴别。形状为圆形厚片，切面黄白色，粉性，有多数细孔的饮片是泽泻（C对）。泽泻：【性状鉴别】饮片为圆形或椭圆形厚片。外表皮淡黄色至淡黄棕色，可见细小突起的须根痕。切面黄白色至淡黄色，粉性，有多数细孔。气微，味微苦。莪术（A错）：【性状鉴别】饮片呈类圆形或椭圆形厚片。外表皮灰黄色或灰棕色，有时可见环节或须根痕，切面黄绿色、黄棕色或棕褐色，内皮层环纹明显，散在“筋脉”小点。气微香，味微苦而辛。丹参（B错）：【性状鉴别】饮片为类圆形或椭圆形的厚片。外表皮棕红色或暗棕红色，粗糙，具纵皱纹。切面有裂隙或略平整而致密，有的呈角质样，皮部棕红色，木部灰黄色或紫褐色，有黄白色放射状纹理。气微，味微苦涩。桔梗（D错）：【性状鉴别】饮片呈椭圆形或不规则厚片，外皮多已除去或偶有残留。切面皮部黄白色，较窄；形成层环纹明显，棕色；木部宽，有较多裂隙。气微，味微甜后苦。板蓝根（E错）：【性状鉴别】饮片呈圆形厚片。外表皮淡灰黄色至淡棕黄色，有纵皱纹。切面皮部黄白色，木部黄色。气微，味微甜后苦涩。